衣服面料所含有的什么成分可能对人体健康产生较严重的影响
A. 染料
B. 染整助剂
C. 纺织纤维
D. A＋B
E. 农药残留

正确答案：D。A＋B

解析：本题考查衣服面料中对人体健康产生较严重影响的成分。衣服面料所含有的某些染料与染整助剂（D对ABCE错）对皮肤有刺激和致敏作用，有些还具有潜在的致癌作用，可能对人体健康产生较严重的影响。